患者痨嗽，干咳无痰，颧红，盗汗，午后及夜间低热，治疗方中不应出现的药物是
A. 知母
B. 麦冬
C. 鳖甲
D. 地骨皮
E. 石膏

正确答案：E。石膏

解析：据题干所述，患者干咳无痰，颧红，盗汗，午后及夜间低热，均为阴虚内热的表现，治疗方中应以滋阴清热药为主，石膏生用清热泻火，除烦止渴，煨用收湿，生肌，敛疮，止血，不具备滋阴清热的功效（E错，为本题正确答案）；知母的功效是清热泻火，滋阴（A对）润燥；麦冬的功效是养阴（B对）润肺，益胃生津，清心除烦；鳖甲的功效是滋阴（C对）潜阳，退热除蒸，软坚散结；地骨皮的功效是凉血除蒸（清虚热）（D对），清肺降火。